高血压患者余某，体重75kg，收缩压170mmHg，舒张压98mmHg，心电图不正常，ST-T改变，有大量饮酒嗜好。针对高血压，医生用降压药控制病情进展是
A. 预防并发症措施
B. 特殊保护
C. 第一级预防措施
D. 第二级预防措施
E. 第三级预防措施

正确答案：E。第三级预防措施